与妇科疾病关系最为密切的脏腑是
A. 肾、肝、心
B. 肾、肝、脾
C. 肾、肝、肺
D. 肾、心、脾
E. 肾、肺、脾

正确答案：B。肾、肝、脾

解析：妇女以血为本。血化生于脾胃，统摄于脾，藏之于肝，宣发于肺，施泄于肾，总属于心，与妇科疾病发生最为有关的是肾、脾、肝三脏（B对）。